毛果芸香碱对青光眼的治疗除外的是
A. 低浓度的毛果芸香碱用于闭角型青光眼
B. 毛果芸香碱可使瞳孔缩小、前房角间隙扩大
C. 高浓度的毛果芸香碱不宜用于青光眼
D. 毛果芸香碱对开角型青光眼早期无效
E. 可使眼内压下降

正确答案：D。毛果芸香碱对开角型青光眼早期无效

解析：低浓度的毛果芸香碱可滴眼用于治疗闭角型青光眼，用药后使患者瞳孔缩小、前房角间隙扩大，眼内压下降。但高浓度时可造成患者症状加重，故不宜使用。本品对开角型青光眼早期也有一定疗效，但机制未明。掌握“毛果芸香碱”知识点。